车前子除能利尿通淋外，又能
A. 清肺化痰
B. 解毒消肿
C. 通经下乳
D. 清热解暑
E. 健脾止泻

正确答案：A。清肺化痰

解析：本题考查的是车前子的功效。车前子除能利尿通淋外，又能清肺化痰（A对）。车前子：【功效】利水通淋，渗湿止泻，明目，清肺化痰。金钱草：【功效】利水通淋，除湿退黄，解毒消肿（B错）。木通：【功效】利水通淋，泄热，通经下乳（C错）。滑石：【功效】利尿通淋，清解暑热（D错）；外用清热收湿敛疮。薏苡仁：【功效】利水渗湿，健脾止泻（E错），除痹，清热排脓。